原发型肺结核的原发综合征的典型表现为
A. 通常位于上野的片状阴影，中央密度较深，周围逐淡
B. 条状边缘模糊阴影，由病变区伸向肺门
C. 肺门及气管、支气管淋巴结肿大
D. 原发病灶、肺门淋巴结及结核性淋巴管炎组成的哑铃状影
E. 两肺散在斑点状密度增高影

正确答案：D。原发病灶、肺门淋巴结及结核性淋巴管炎组成的哑铃状影

解析：原发型肺结核的原发综合征的典型表现为：原发病灶、肺门淋巴结及结核性淋巴管炎组成的哑铃状影（D对），通常位于上野的片状阴影，中央密度较深，周围逐淡（A错）是继发性浸润性肺结核的影像学表现。条状边缘模糊阴影，由病变区伸向肺门（B错）是纤维空洞型肺结核的典型影像学表现。肺门及气管、支气管淋巴结肿大（C错）是胸内淋巴结结核的典型影像学表现。两肺散在斑点状密度增高影（E错）是血型粟粒型肺结核的典型影像学表现。